29岁孕妇，妊娠32周。3周内阴道少量流血2次，今晨突然阴道流血多于月经量，无腹痛。血压13.3/10.7kpa，脉率96次/分，宫高30cm，腹围85cm，臀先露，未入盆，胎心清楚，144次/分。下述何项处理是错误的
A. 住院观察
B. 绝对卧床休息
C. 配血备用
D. 口服镇静药
E. 肛指检查

正确答案：E。肛指检查

解析：发生前置胎盘时需要住院观察（A对），以便对母体和胎儿进行精确地电子监护；应当取侧卧位，绝对卧床休息（B对），止血后方可轻微活动；当阴道流血量多时，应建立静脉通道，输血输液，止血，配血备用（C对）以补充血容量及纠正贫血；口服镇静药（D对）能抑制宫缩，以提高围产儿存活率。前置胎盘不宜进行肛指检查，以免加重出血（E错，为本题正确答案）。